藿香正气水的功能是
A. 解表化湿
B. 疏散风热
C. 祛风清热
D. 温中止呃
E. 理气和中

正确答案：A、E。解表化湿；理气和中

解析：本题考查的是藿香正气水的功能。藿香正气水的功能是解表化湿（A对）与理气和中（E对）。藿香正气水：【功能】解表化湿，理气和中。银翘解毒丸：【功能】疏风解表，清热解毒（B错）。消银颗粒：【功能】清热凉血，养血润肤，祛风（C错）止痒。功能为温中止呃（D错）的中成药，2022年考试指南未明确说明。